“用寒远寒，用热远热”属于
A. 因病制宜
B. 因地制宜
C. 因人制宜
D. 因时制宜
E. 因证制宜

正确答案：D。因时制宜

解析：“用寒远寒”是指寒冬时节，人体阴盛而阳气内敛，腠理致密，若病热证，也应当慎用寒凉之品，以防损伤阳气；“用热远热”是指夏季炎热，机体也处于阳盛之时，腠理疏松开泄，易于汗出，即使感受风寒而致病，也不宜过用辛温发散之品。这是根据季节的不同而采用不同的治疗方法，故属因时制宜（D对ABCE错）。